用于评价药物脂溶性的参数
A. pKₐ
B. ED₅₀
C. LD₅₀
D. LgP
E. HLB

正确答案：D。LgP

解析：本题考查药代动力学参数。用于评价药物脂溶性的参数是lgP（D对）。脂水分配系数P为化合物在脂相和水相间达到平衡时的浓度比值，常用其对数lgP来表示。pKₐ（A错）在化学及生物化学中，是指一个特定的平衡常数，以代表一种酸离解氢离子的能力，是由其化学结构决定的。半数有效量是指引起50%阳性反应（质反应）或50%最大效应（量反应）的浓度或剂量，分别用半数有效量（ED₅₀）（B错）及半数有效浓度（EC₅₀）表示。半数致死量（LD₅₀）（C错）是用于评价药物急性中毒的参数。HLB（E错）是用于评价表面活性剂的参数。